虹膜与角膜间的环行区域称
A. 睫状体
B. 虹膜角膜角隙
C. 虹膜角膜角
D. 小梁网
E. 睫前静脉

正确答案：C。虹膜角膜角

解析：虹膜与角膜间的环行区域称虹膜角膜角（C对）。